属于第四代头孢菌素的药物是
A. 头孢氨苄
B. 头孢哌酮
C. 头孢吡肟
D. 头孢拉定
E. 头孢呋辛

正确答案：C。头孢吡肟

解析：本题考查头孢菌素的分类。头孢吡肟（C对）属于第四代头孢菌素。第一代头孢菌素常用品种有头孢唑林和头孢拉定注射剂，口服制剂头孢拉定（D错）、头孢氨苄（A错）和头孢羟氨苄等。第二代头孢菌素常用的注射剂有头孢呋辛（E错）和头孢替安，口服制剂有头孢克洛、头孢呋辛酯和头孢丙烯等。第三代头孢菌素注射品种有头孢噻肟、头孢曲松、头孢他啶和头孢哌酮（B错）等。口服制剂有头孢克肟、头孢泊肟酯等。第四代头孢菌素常用者为头孢吡肟。第五代头孢菌素代表药有头孢洛林酯、头孢托罗、头孢吡普等。